诊断病毒性肝炎最可靠的指标
A. 发病季节
B. 起病方式
C. 症状及体征
D. 接触史
E. 病原学及肝功检查

正确答案：E。病原学及肝功检查

解析：诊断病毒性肝炎最可靠的指标是病原学及肝功检查（E对），病原学能清晰反应所感染病毒是哪一种，而肝功检查能反应肝脏各项指标是否升高与降低。发病季节（A错）、起病方式（B错）、症状与体征（C错）、接触史（D错）均无特异性。